左侧小脑中脚纤维主要来自
A. 左侧大脑皮质
B. 右侧大脑皮质
C. 左侧脑桥核
D. 右侧脑桥核
E. 无

正确答案：D。右侧脑桥核

解析：小脑位于颅后窝，借其上、中、下三对小脑脚连于脑干的背面。其中小脑中脚最粗大，位于最外侧，连于小脑和脑桥之间，其内的纤维为小脑传入纤维，几乎全部由对侧脑桥核发出的脑桥小脑纤维构成。因而左侧小脑中脚纤维主要来自右侧脑桥核（D对）而不是左侧脑桥核（C错）。